女性，32岁，阵发性上腹痛2年，夜间加重，疼痛有季节性，冬季明显，有反酸，为进一步确诊，首选的检查方法是
A. X线钡餐检查
B. CT检查
C. 胃液细胞学检查
D. 胃液分析
E. B超

正确答案：A。X线钡餐检查

解析：中年女性患者，阵发性上腹痛2年，疼痛有季节性，冬季明显（消化性溃疡发作有季节性，多在秋冬和冬春之交发病），夜间加重（十二指肠溃疡多表现为夜间痛），考虑诊断为十二指肠溃疡。为进一步确诊，首选的检查方法是X线钡餐检查（A对）（首选检查方法一般选胃镜检查，但该题目没有此选项）。CT检查（B错）和B超（E错）适用于肝癌、急性胰腺炎等实质性脏器疾病的的诊断。胃液细胞学检查（C错）适用于胃癌的诊断。胃液分析（D错）可测定基础胃酸分泌量（BAO）和最大胃酸分泌量（MAO），用于了解溃疡病患者胃酸分泌情况，现已少用。